甲是药品上市许可持有人，持有并生产的品种包括处方药硝苯地平控释片、鱼腥草注射液；中药饮片黄芪；非处方药维生素C泡腾片。乙是药品批发企业，长期与甲保持业务关系，从甲处采购硝苯地平控释片、中药饮片黄芪、维生素C泡腾片。最近决定首次从甲处采购鱼腥草注射液，甲将乙釆购的四种药品同车运输至乙处，乙将到货药品储存在同一间库房。下列甲和乙运输、储存药品的质量管理行为中，不符合规定的是
A. 将中药饮片黄芪和鱼腥草注射液同库储存
B. 将硝苯地平控释片和鱼腥草注射液同库储存
C. 将硝苯地平控释片和维生素C泡腾片同库储存
D. 将维生素C泡腾片和鱼腥草注射液同车运输

正确答案：A。将中药饮片黄芪和鱼腥草注射液同库储存

解析：本题考查的是药品经营质量管理规范的零售主要内容。甲是药品上市许可持有人，持有并生产的品种包括处方药硝苯地平控释片、鱼腥草注射液；中药饮片黄芪；非处方药维生素C泡腾片。乙是药品批发企业，长期与甲保持业务关系，从甲处采购硝苯地平控释片、中药饮片黄芪、维生素C泡腾片。最近决定首次从甲处采购鱼腥草注射液，甲将乙釆购的四种药品同车运输至乙处，乙将到货药品储存在同一间库房。下列甲和乙运输、储存药品的质量管理行为中，不符合规定的是将中药饮片黄芪和鱼腥草注射液同库储存（A错，为本题正确答案）。药品零售企业的库房设施设备：企业设置库房的，应当做到库房内墙、顶光洁，地面平整，门窗结构严密；有可靠的安全防护、防盗等措施。储存中药饮片应当设立专用库房。经营特殊管理的药品应当有符合国家规定的储存设施。药品零售企业的仓库应当有以下设施设备：药品与地面之间有效隔离的设备；避光、通风、防潮、防虫、防鼠等设备；有效监测和调控温湿度的设备；符合储存作业要求的照明设备；验收专用场所；不合格药品专用存放场所；经营冷藏药品的，有与其经营品种及经营规模相适应的专用设备。企业应当按照国家有关规定，对计量器具、温湿度监测设备等定期进行校准或者检定。